RPA卡环组卡环臂的坚硬部分应与颊面观测线
A. 重合
B. 偏上
C. 偏下
D. 偏左
E. 偏右

正确答案：A。重合

解析：本题考查局部义齿固位体。RPA卡环组要求基牙排列正常，观测线位于牙冠的中部，以便获得颊面近、远中两个倒凹区。卡环臂的坚硬部分应与颊面观测线重合（A对），既不能高于观测线位于非倒凹区，也不能低于观测线位于倒凹区。